指出下列药物中，哪些具有利尿作用
A. 氢氯噻嗪
B. 氯贝丁酯
C. 福尔可定
D. 依他尼酸
E. 马布特罗

正确答案：A、D。氢氯噻嗪；依他尼酸

解析：本题考查利尿药。具有利尿作用的是氢氯噻嗪（A对）、依他尼酸（D对）。依他尼酸使高效利尿药，临床上用于充血性心力衰竭、急性肺水肿、肝硬化腹水、肝癌腹水、血吸虫病腹水、脑水肿以及其他水肿。氢氯噻嗪为中效利尿药，临床上用于各种原因引起的水肿、高血压病、肾性尿崩症及加压素无效的垂体性尿崩症等。氯贝丁酯（B错）为调血脂药。福尔可定（C错）为镇咳药。马布特罗（E错）为平喘药。